材料二：甲为A省药品生产企业，持有小柴胡冲剂等药品批准文号；乙为B省药品批发企业，负责甲生产的所有药品在B省的经营业务。丙为C省广告公司，业务范围包括广设计与平面媒体、视频媒体的广告投放。为增加B省市场销量，甲拟在B省电视、报刊上发布广告。丙为甲设计小柴胡冲剂广告时邀请D省某中医院内科主任医师丁某在视频中介绍说明书中标识的功能主治、禁忌症和不良反应等内容。甲取得药品广告批准文号后，拟将广告发布范围扩大至C省，其正确的做法是
A. 向C省药品监督管理部门提出申请，获得批准后即可发布
B. 向C省药品监督管理部门承诺符合条件并提交材料，当场备案后即可发布
C. 向C省新闻宣传部门办理备案，待其与药品广告批准文号核发机构确认后，即可发布
D. 向C省药品监督管理部门办理备案，待其与药品广告批准文号核发机构确认后即可发布

正确答案：B。向C省药品监督管理部门承诺符合条件并提交材料，当场备案后即可发布

解析：本题考查药品广告监督管理。异地发布广告应向发布地省药品监督管理局进行备案，简化异地备案，实施告知承诺，对申请人承诺符合条件并条件材料的，当场予以备案（B对）。